关于痈的治疗正确的是
A. 初期只有红肿时，热敷治疗
B. 当表面紫褐色己破溃流脓时，不必切开
C. 切开引流时作“十”形切口
D. 切口应达病变边缘皮肤
E. 切口应深达筋膜深面

正确答案：C。切开引流时作“十”形切口

解析：痈的皮下病变广泛，治疗时须充分引流，作“＋”形切口以充分暴露感染面（C对）。因为皮下病变区域比皮肤病变更广，切口线应超出病变边缘（D错）。切开皮肤要深达筋膜（但不需要达到筋膜深面）（E错），切断皮下纤维小梁，清除已化脓和尚未成脓、但已经失活的组织。当皮肤表面呈紫褐色己破溃流脓时，表明该处皮肤已经坏死及化脓，应予以切开清创（B错）。